脱色疗法使用的药物为
A. 40％过氧化脲
B. 40％过氧化氢
C. 30％过氧化脲
D. 30％过氧化氢
E. 以上均可

正确答案：D。30％过氧化氢

解析：本题考查脱色疗法。脱色疗法使用的药物常为为30%过氧化氢（D对B错），也可使用10%～15%过氧化脲（AC错）、过硼酸钠等。